患者，女，75岁，近来因家庭变故出现焦虑相关的精神和躯体症状，入睡困难，多梦易惊醒，诊断为焦虑症。核查其用药记录，患者在服用氨氯地平、阿托伐他汀钙。对急性期焦虑的治疗，首选的药物是
A. 5-羟色胺和去甲肾上腺素再摄取抑制剂
B. 选择性5-羟色胺再摄取抑制剂
C. 三环类抗抑郁药
D. 苯二氮䓬类药物
E. 单胺氧化酶抑制剂

正确答案：D。苯二氮䓬类药物

解析：本题考查急性期焦虑的首选药。苯二氮䓬类药物（D对）起效快，抗焦虑作用强，对急性期焦虑患者可考虑短期使用，一般治疗时间不超过2～3周。5-羟色胺和去甲肾上腺素再摄取抑制剂（A错）主要用于抑郁症和广泛性焦虑症。选择性5-羟色胺再摄取抑制剂（B错）具有抗抑郁和抗焦虑的双重作用。三环类抗抑郁药（C错）用于治疗各类以抑郁症状为主的精神障碍。单胺氧化酶抑制剂（E错）用于各类抑郁发作，包括非典型性抑郁、恶劣心境、老年抑郁。